某水溶性维生素人体需要量与热能摄入量有关，红细胞内谷胱甘肽还原酶活性与其水平有关。该营养素为
A. 维生素B₁
B. 维生素B₂
C. 维生素C
D. 维生素A
E. 以上都不是

正确答案：B。维生素B₂